既为五体，又为奇恒之腑的是
A. 胆
B. 筋
C. 肉
D. 脉
E. 髓

正确答案：D。脉

解析：本题考查的是五体与奇恒之腑。既为五体，又为奇恒之腑的是脉（D对）。体，即形体。广义的形体，泛指人体的身形和躯体。狭义的形体，指脉、筋（B错）、肌肉（C错）、皮肤、骨，称为五体。奇恒之腑，即脑、髓（E错）、骨、脉、胆（A错）、女子胞。